抗精神病药物的抗精神病作用的主要通路是
A. 锥体外系统
B. 结节-漏斗系统
C. 网状上行系统
D. 中脑-边缘系统
E. 黑质-纹状体系统

正确答案：D。中脑-边缘系统

解析：脑内多巴胺能系统有四条投射通路：其中中脑－边缘通路与抗幻觉妄想等抗精神病作用有关（D对）；下丘脑至垂体的结节漏斗通路与催乳素水平升高导致的副作用有关（B错）；黑质－纹状体通路与椎体外系副作用有关（E错）；中脑皮质通路与药源性阴性症状和抑郁有关。